在某项关于吸烟和肺癌的研究中，某医师认为其中的年龄是混杂因子，这里的混杂因子是指
A. 与研究的疾病有联系的因子
B. 与研究的疾病没有联系的因子
C. 与研究的疾病和暴露都没有联系的因子
D. 与研究的疾病和暴露有联系的因子
E. 上述都不对

正确答案：D。与研究的疾病和暴露有联系的因子

解析：本题考查混杂因子。混杂因子也称混杂因素，是指与研究因素和研究疾病均有关（D对ABCE错），若在比较的人群组中分布不匀，可以歪曲（掩盖或夸大）因素与疾病之间真正联系的因素。混杂因子的成立具备三个条件：1.必须是所研究疾病的独立危险因子；2.与研究因素（暴露因素）有关；3.不是研究因素与研究疾病因果链上的中间变量。